男，6个月。患法洛四联症。近2天反复于哭闹时突然四肢抽搐，青紫加重，神志不清，呼吸急促，持续时间约2～3分钟。主要原因是
A. 脑栓塞
B. 肺动脉梗阻
C. 心力衰竭
D. 脑炎
E. 心包炎

正确答案：B。肺动脉梗阻

解析：患儿，在法洛四联症的基础上有阵发性抽搐昏厥的临床表现，其原因是肺动脉梗阻（B对），法洛四联症本身就是最易发生缺氧紫绀的，当肺动脉漏斗部狭窄的基础上突然发生该处肌部痉挛，引起一时性肺动脉梗阻时，会进一步加重缺氧，导致患儿出现抽搐、青紫加重、神智不清等临床反应。脑栓塞（A错）和心力衰竭（C错）一般是发生在有多年动脉粥样硬化病史的老年人当中。脑炎多发生在感染性疾病的基础上，并且会有颅内压增高以及脑膜刺激症等，而该患儿并没有这些表现（D错）。心包炎一般会有3周左右上感史，但心包炎很少有缺氧的表现（E错），另外法洛四联症很少并发心肌炎。